良性肿瘤与恶性肿瘤的主要鉴别是
A. 有无包膜
B. 生长速度
C. 分化程度
D. 疼痛程度
E. 有无溃疡

正确答案：C。分化程度

解析：肿瘤的分化是指肿瘤组织在形态和功能上与某种正常组织的形似之处，相似的程度称为肿瘤的分化程度，即分化程度越低，肿瘤的恶性程度越高。故分化程度（C对）可作为区别良恶性肿瘤的重要指标。有无包膜（A错）不能作为别良恶性肿瘤的指标，如血管瘤无包膜，但属于良性肿瘤。生长速度（B错）不能作为鉴别指标，如基底细胞癌生长缓慢但属于恶性肿瘤。疼痛程度（D错）不能作为鉴别指标，无论良恶性，当肿瘤生长压迫周围组织、神经时都可出现疼痛症状。有无溃疡（E错）亦不能判断良恶性，如白血病属于恶性肿瘤，但无溃疡表现。